根据《化妆品监督管理条例》，需要由国家药品监督管理局注册的是
A. 有清洁功效的化妆品原料
B. 宣称新功效的化妆品
C. 用于染发的化妆品
D. 具有防晒功能的化妆品新原料

正确答案：B、C、D。宣称新功效的化妆品；用于染发的化妆品；具有防晒功能的化妆品新原料

解析：本题考查化妆品的界定和分类。经国家药品监督管理部门注册后方可生产的有宣称新功效的化妆品（B对）；用于染发的化妆品（C对）；具有防晒功能的化妆品新原料（D对）。国家对特殊化妆品实行注册管理，对普通化妆品实行备案管理。用于染发、烫发、祛斑美白、防晒、防脱发的化妆品以及宣称新功效的化妆品为特殊化妆品。化妆品原料分为新原料和已使用的原料，国家对风险程度较高的化妆品新原料实行注册管理，对其他化妆品新原料实行备案管理。在我国境内首次使用于化妆品的天然或者人工原料为化妆品新原料，具有防腐、防晒、着色、染发、祛斑美白功能的化妆品新原料，经国务院药品监督管理部门注册后方可使用；其他化妆品新原料应当在使用前向国务院药品监督管理部门备案（A错）。